视神经起始处形成的结构是
A. 瞳孔
B. 巩膜静脉窦
C. 虹膜角膜角
D. 视神经盘
E. 黄斑中央凹

正确答案：D。视神经盘

解析：视神经起始处形成的结构是视神经盘（D对）